气滞血瘀而致痛经，经期最佳治法是
A. 理气行滞，调经止痛
B. 理气行滞，化瘀止痛
C. 疏肝理气，行滞止痛
D. 理气行滞，活血调经
E. 疏肝理气，活血行滞

正确答案：B。理气行滞，化瘀止痛

解析：痛经气滞血瘀证是由于素性抑郁，或忿怒伤肝，肝郁气滞，气滞血瘀，或经期产后，余血内留，蓄而成瘀，瘀滞冲任，血行不畅，经前经时气血下注冲任，胞脉气血更加壅滞，“不通则痛”，而致。治疗时应理气行滞，化瘀止痛，可选用膈下逐瘀汤（B对）。